环境中的主要致癌因素是
A. 物理有害因素
B. 化学有害因素
C. 生物有害因素
D. 食物中有害因素
E. 其他因素

正确答案：B。化学有害因素

解析：本题考查环境中的主要致癌因素。致癌因素可分为物理性有害因素、化学性有害因素和生物性有害因素。其中，化学性有害因素（B对ACDE错）是环境中的主要致癌因素，它包括多种有害物质，如汞、铅、有毒气体、甲醛、苯等，这些有害物质可以通过空气、水和食物等途径进入人体，并在人体内积聚，对人体健康产生有害影响，导致某些癌症的发生。